关于牙本质龋描述哪项是错误的
A. 牙本质内含有机物较多，除了有无机晶体的溶解外，还存在有机基质的分解破坏
B. 牙本质龋是沿着牙本质小管快速进展
C. 防御性反应可表现为硬化牙本质的形成
D. 由表层至深层可分为透明层、暗层、病损体部、表层
E. 牙本质龋在病理形态上是一个三角形病变，三角形的顶指向牙髓腔

正确答案：D。由表层至深层可分为透明层、暗层、病损体部、表层

解析：本题考查牙本质龋。关于牙本质龋描述由表层至深层可分为透明层、暗层、病损体部、表层（D错，为本题正确答案）是错误的。一般可将牙本质龋的病理改变由病损深部向表面分为四层结构：①透明层；②脱矿层；③细菌侵入层；④坏死崩解层。